咀嚼肌肌力闭合道的终点颌位是
A. 后退接触位
B. 侧颌颌位
C. 下颌姿势位
D. 前伸（牙合）颌位
E. 牙尖交错位

正确答案：E。牙尖交错位

解析：本题考查颌位。咀嚼肌肌力闭合道的终点颌位是牙尖交错位（E对）。当开口再闭口时，下颌随升颌肌作用的方向而运动，其运动轨迹被称为肌力闭合道。牙尖交错位（ICP）是指上下颌牙牙尖交错，达到最广泛、最紧密接触时下颌所处的位置，即牙尖交错（牙合）时下颌骨相对于上颌骨或者颅底的位置关系。ICP可重复，一生之中相对稳定，逐渐变化，是下颌咀嚼肌肌力闭合道的终点。后退接触位（A错）从牙尖交错位下颌可以向后移动约1mm，此时，前牙不接触，只有后牙牙尖斜面部分接触，髁突在下颌窝中的位置是下颌的生理最后位，不能再向后退，从此位置下颌可以做侧向运动和单纯铰链运动。侧颌颌位（B错）下颌在保持一侧上下牙接触的同时向该侧移动，运动过程中所有下颌的位置称为侧牙合颌位。它的临床应用是，检查后牙咀嚼功能的基准位。因为后牙尖对尖位时是发挥咀嚼功能的起始咬合接触位。下颌姿势位（C错）曾称为息止颌位。当头直立位，口腔在不咀嚼、不吞咽、不说话的时候，下颌处于休息状态，上下颌牙弓自然分开，从后向前保持着一个楔形间隙，称为息止（牙合）间隙，也称为自由间隙，约为1-3mm。此时下颌所处的位置，称为下颌姿势位。前伸（牙合）颌位（D错）下颌相对于上颌，位于ICP前方的下颌位置。在义齿修复中，咬合关系前伸时前、后牙都接触，为前伸平衡牙合。